药品质量标准的主要内容有
A. 性状
B. 鉴别
C. 检查
D. 含量测定
E. 剂量

正确答案：A、B、C、D。性状；鉴别；检查；含量测定

解析：本题考查药品标准。药品质量标准的主要内容有性状（A对）、鉴别（B对）、检查（C对）、含量测定（D对）。药品的质量标准收载于《中国药典》的正文部分，基本内容主要包括性状、鉴别、检查、含量测定、类别、贮藏、制剂等。剂量（E错）不属于药品质量标准的主要内容。